语言发育的节段性总结正确的是
A. 1～2个月—咿呀阶段
B. 3～4个月—哭叫阶段
C. 5～10个月—单音阶段
D. 1～2岁—成语阶段
E. 3岁以后—单词阶段

正确答案：C。5～10个月—单音阶段

解析：语言发育的节段性总结：哭叫阶段：1～2个月；咿呀阶段：3～4个月；单音阶段：5～10个月；单词阶段：1～2岁，成语阶段：3岁以后。掌握“运动和语言发育”知识点。